小儿泻速停颗粒的主治是
A. 脾虚泄泻
B. 食积泄泻
C. 湿热泄泻
D. 寒湿泄泻
E. 五更泄泻

正确答案：C。湿热泄泻

解析：本题考查的是小儿泻速停颗粒的主治。小儿泻速停颗粒的主治是湿热泄泻（C对）。小儿泻速停颗粒：【主治】小儿湿热蕴结大肠所致的泄泻，症见大便稀薄如水样、腹痛、纳差；小儿秋季腹泻及迁延性、慢性腹泻见上述证候者。止泻灵颗粒：【主治】脾胃虚弱所致的泄泻（A错）、大便溏泄、饮食减少、腹胀、倦怠懒言；慢性肠炎见上述证候者。健脾康儿片：【主治】脾胃气虚所致的泄泻，症见腹胀便泻、面黄肌瘦、食少倦怠、小便短少。健脾康儿片以健脾补虚为主，兼能消食。具有健脾养胃、消食止泻之功，主治脾胃气虚、食积不化所致的泄泻（B错）。草豆蔻：【主治病证】（1）寒湿中阻之胀满疼痛。（2）寒湿中阻之呕吐、泄泻（D错）。四神丸：【主治】肾阳不足所致的泄泻，症见肠鸣腹胀、五更泄泻（E错）、食少不化、久泻不止、面黄肢冷。